体外无抗肿瘤活性，在肝脏转化后发挥作用的药物是
A. 氮芥
B. 噻替派
C. 白消安
D. 环磷酰胺
E. 丝裂霉素

正确答案：D。环磷酰胺

解析：本题考查环磷酰胺的药物活性。体外无抗肿瘤活性，在肝脏转化后发挥作用的药物是环磷酰胺（D对）。环磷酰胺在体外无抗肿瘤活性，在肝脏转化后发挥作用才激活抗肿瘤活性。氮芥（A错）、塞替派（B错）、白消安（C错）、丝裂霉素（E错）无此肝脏转化激活过程。